关于卡托普利，下列哪种说法错误
A. 降低外周血管阻力
B. 可用于治疗心衰
C. 与利尿药合用可加强其作用
D. 可增加体内醛固酮水平
E. 双侧肾动脉狭窄的患者忌用

正确答案：D。可增加体内醛固酮水平